血氧饱和度一般是指
A. 血液中溶解的02量与总02量的比值
B. 与02结合的Hb占总Hb的百分数
C. Hb02和未结合的02的Hb的比值
D. 与Hb结合的02占氧含量的百分数
E. 未结合的02的Hb量和Hb总量的比值

正确答案：B。与02结合的Hb占总Hb的百分数

解析：血液中氧合Hb占总Hb的百分数即为血氧饱和度，一般是指血液中血红蛋白与O2结合的Hb占总Hb的百分数（B对）。